诊断抑郁发作的必要条件是
A. 早醒
B. 自杀观念
C. 思维迟缓
D. 动作减少
E. 心境低落

正确答案：E。心境低落

解析：抑郁发作通常有心境低落（E对）、兴趣和愉快感丧失、精力不济或疲劳感等典型症状。伴有兴趣缺乏、快感缺失、思维迟缓、意志活动减少、精神运动性迟滞或激越、自责自罪、自杀观念和行为、早醒、食欲减退、体重下降、性欲减退、抑郁心境晨重晚轻的节律改变等。早醒、自杀观念、思维迟缓、动作减少均为抑郁发作的临床表现，但均不是必要条件（ABCD错）。